下列各项组合中，能准确判断酸中毒性质严重程度和代偿情况的是
A. 动脉血和尿的pH值
B. 动脉血pH值和HCO₃⁻
C. 动脉血和静脉血pH值
D. 动脉血和静脉血PaCO₂
E. 静脉血和尿的pH值

正确答案：B。动脉血pH值和HCO₃⁻

解析：根据酸碱平衡公式，正常动脉血的pH为：pH=6.1+logHCO₃⁻/（0.03×PaCO₂），从上述公式可见，判断酸碱失衡最重要的因素是动脉血中的pH、HCO₃⁻及PaCO₂（B对）。尿液和静脉血都是动脉血经过体内各组织器官代谢后而产生，不能准确判断酸碱失衡情况（ACDE错）。